下列何结构感受直线变速运动的刺激
A. 椭圆囊斑
B. 球囊斑
C. 椭圆囊斑和球囊斑
D. 螺旋器(Corti器）
E. 无

正确答案：C。椭圆囊斑和球囊斑

解析：椭圆囊斑和球囊斑均属位觉感受器，感受头部静止的位置及直线变速运动引起的刺激（C对）。螺旋器(Corti器）是听觉感受器（D错）。